女，22岁。双眼睑下垂1年余，诊断为重症肌无力。胸部CT发现前上纵隔占位，大小约2cm×2cm×1cm，最可能的诊断是
A. 神经纤维瘤
B. 胸内甲状腺
C. 胸腺瘤
D. 畸胎瘤
E. 淋巴瘤

正确答案：C。胸腺瘤

解析：本例患者青年女性，出现双眼睑下垂1年余，并且已经诊断为重症肌无力，胸部CT发现前上纵隔占位，大小约2cm×2cm×1cm，根据患者重症肌无力的诊断及肿块发生部位考虑诊断为胸腺瘤（C对）。胸腺瘤是最常见的纵膈肿瘤之一，多位于前上纵隔，最常见的并发症为重症肌无力。神经纤维瘤（A错）发病部位以肢体多见，会出现病损神经支配区的疼痛、麻木、感觉过敏等症状，无重症肌无力表现。胸内甲状腺（B错）多表现为气管受压症状：如刺激性咳嗽、呼吸困难等，还有胸内闷胀感或胸背部疼痛，少数病例有甲状腺机能亢进症状，无重症肌无力表现。畸胎瘤（D错）好发于性腺及纵隔，尤其是前下纵隔，CT检查应表现为块状密度均匀不一的肿块，可有钙化，多因为压迫临近组织而出现相应症状，无重症肌无力表现。淋巴瘤（E错）累及纵隔淋巴结时，CT下会有多发肿块存在，常会因压迫气管、上腔静脉等而伴有呼吸困难、上腔静脉综合征等表现。